在高温环境中，哪一种方式并非人体的散热表现
A. 血液重新分配
B. 大量出汗，汗液蒸发散热
C. 细胞耗氧量增加
D. 产热中枢抑制，自身产热下降
E. 血管放射性扩张

正确答案：C。细胞耗氧量增加